不能体现知情同意的是
A. 以健康人或病人作为受试对象
B. 实验时使用对照和双盲法
C. 不选择弱势人群作为受试者
D. 实验中受试者得到专家的允许后可自由决定是否退出
E. 弱势人群若参加实验，需要监护人的签字

正确答案：A。以健康人或病人作为受试对象

解析：知情同意是人体实验进行的前提，受试者必须充分知晓实验信息并自愿同意参加并履行书面的承诺手续后，才能在其身体上进行人体实验。未取得知情同意而以健康人或病人作为受试对象（A错，为本题正确答案），不能体现人体实验知情同意的伦理原则。缺乏或丧失知情同意能力的弱势人群若参加实验，需要监护人的签字（E对），体现了人体实验知情同意的伦理原则。